三级预防的作用不包括防止
A. 伤残
B. 合并症
C. 后遗症
D. 复发
E. 慢性病

正确答案：E。慢性病

解析：本题考查三级预防的作用。第三级预防又称临床预防或疾病管理，发生在疾病的症状体征明显表现出来之后。早期，通过适当的治疗缓解症状，预防疾病进一步恶化，预防急性事件的发生和复发（D对），预防合并症（B对）和残疾（A对）的发生。到了疾病晚期，通过早期发现和管理合并症，对已经发生的残疾进行康复治疗，最大限度的恢复个体的机体功能和社会功能（C对），提高生活质量，延长寿命。防止慢性病（E错，为本题正确答案）是二级预防的作用。